患儿，5岁。面色不华，已逾3个月，指甲苍白，纳食不佳，四肢乏力，大便溏泻，舌淡苔薄白，脉细无力。血常规提示小细胞低色素性贫血。治疗首选的方剂是
A. 大补元煎
B. 八珍汤
C. 补中益气汤
D. 保和丸
E. 参苓白术散

正确答案：E。参苓白术散

解析：本题患者为小细胞低色素性贫血症，因脾胃虚弱，脾胃的运化、受纳、腐熟功能失职，则纳食不佳。脾虚水湿不运则大便溏泻。脾虚气血生化乏源，肢体失养，则四肢乏力、指甲苍白；面部失荣则面色不华。舌淡苔薄白，脉细无力为脾胃虚弱证之象，宜用具有益气健脾、除湿止泻功效的六君子汤（E对）；大补元煎具有益气养血、滋补肝肾的功效，用于治疗气血两虚证，症见头晕目眩，少气懒言，神疲乏力，自汗，面色淡白或萎黄，唇甲淡白，心悸失眠，形体消瘦，舌淡嫩，脉细弱（A错）；八珍汤具有益气补血之功效，主治气血两虚证，症见面色苍白或萎黄，头晕耳眩，四肢倦怠，气短懒言，心悸怔忡，饮食减少，舌淡苔薄白，脉细弱或虚大无力（B错）；补中益气汤具有补中益气，升阳举陷之功效，主治脾虚气陷证，症见饮食减少，体倦肢软，少气懒言，面色萎黄，大便稀溏，舌淡，脉虚（C错）；保和丸具有消食，导滞，和胃之功效。主治食积停滞，脘腹胀满，嗳腐吞酸，不欲饮（D错）。